可作为水、食物和药品的卫生检测指标，它的存在表明外环境、水和食物被人或动物粪便污染，且污染程度与其数量相关的是
A. 肺炎杆菌
B. 痢疾杆菌
C. 伤寒杆菌
D. 变形杆菌
E. 大肠埃希菌

正确答案：E。大肠埃希菌

解析：大肠埃希菌为人和动物肠道寄生菌之一，它的存在表明外环境、水和食物被人或动物粪便污染，且污染程度与其数量相关，作为水、食物和药品的卫生检测指标。掌握“肠道杆菌共性及埃希氏菌属”知识点。